当归的药理作用有
A. 保肝
B. 降血脂
C. 降血压
D. 促进免疫功能
E. 抗心肌缺血

正确答案：B、C、D、E。降血脂；降血压；促进免疫功能；抗心肌缺血

解析：本题考查的是当归的药理作用。当归的药理作用有降血脂（B对）、降血压（C对）、促进免疫功能（D对）与抗心肌缺血（E对）。当归的药理作用：当归具有抗贫血、增强免疫功能，调节血压，降血脂等作用。当归能增加外周血细胞数，促进造血功能，这种作用在外周血细胞减少和骨髓受到抑制时尤为明显。当归可降低血液黏滞性，延长凝血酶原时间，当归、阿魏酸能抑制血小板的聚集和释放，具有改善血液流变性、抗血栓作用。当归可降低甘油三酯水平，减少主动脉斑块面积，当归、阿魏酸能保护血管壁内膜，抑制脂质沉积于血管壁达到抗动脉粥样硬化的作用。当归具有抗心肌缺血、抗脑缺血作用。当归可增加心肌氧的供给，减少氧的消耗，减轻心肌梗死范围。阿魏酸是当归抗心肌缺血的有效成分。当归注射液对急性脑缺血模型，可明显改善脑缺血症状。保肝（A错）为穿心莲的药理作用。穿心莲的药理作用：穿心莲内酯为穿心莲抗炎作用的主要活性成分，临床已用于治疗急性菌痢、胃肠炎、咽喉炎、感冒发热等。穿心莲具有降血糖、保肝等作用。